关于钠泵生理作用的描述，不正确的是
A. 钠泵活动使膜内钠、钾离子均匀分布
B. 将钠离子移出膜外，将钾离子移入膜内
C. 建立势能储备，为某些营养物质吸收创建条件
D. 细胞外高钠离子可维持细胞内外正常渗透压
E. 细胞内高钾离子保证许多细胞代谢反应进行

正确答案：A。钠泵活动使膜内钠、钾离子均匀分布